心烦尿赤、口舌生疮之症，可选用
A. 萹蓄
B. 茯苓
C. 滑石
D. 木通
E. 金钱草

正确答案：D。木通

解析：木通能上清心经之火，下泄小肠之热，常用于治心火上炎，口舌生疮，或心火下移于小肠而致的心烦尿赤（D对）。萹蓄（A错）性微寒，主入膀胱经，能清利下焦湿热，多用于热淋涩痛，小便短赤，以及石淋等。茯苓（B错）能利水消肿，又能健脾补中，用于脾虚湿盛之水肿腹胀，小便不利，脾虚泄泻等。滑石（C错）性滑利窍，寒则清热，用于治疗暑湿烦渴，湿温初起，热淋，石淋，尿热涩痛，小便不利，热水泻等。金钱草（E错）既能清肝胆之热，又能除下焦湿热，用于治疗湿热黄疸，胁肋胀痛，石淋，热淋，小便涩痛。